蛋白质-热能营养不良小儿最先出现的症状是
A. 身高低于正常
B. 皮下脂肪消失
C. 体重不增
D. 体重减轻
E. 肌张力低下

正确答案：C。体重不增

解析：营养不良是由于缺乏能量和（或）蛋白质所致的一种营养缺乏症，主要见于三岁以下小儿，特征为体重不增、体重下降、渐进性消瘦或水肿、皮下脂肪减少或消失，早期表现是活动少、精神较差、体重生长速度不增（C对）。